在糖尿病的病因研究中，选择100名糖尿病病人，同时选择200名在年龄、性别、职业和受教育程度方面相似的非糖尿病病人，然后比较两组肥胖的比例。这是一种
A. 病例对照研究
B. 回顾性队列研究
C. 前瞻性队列研究
D. 生态学研究
E. 实验性研究

正确答案：A。病例对照研究